下列药物中属于前体药物的有
A. 洛伐他汀
B. 赖诺普利
C. 马来酸依那普利
D. 卡托普利
E. 福辛普利

正确答案：A、C、E。洛伐他汀；马来酸依那普利；福辛普利

解析：本题考查他汀类药物。下列药物中属于前体药物的有洛伐他汀（A对）、马来酸依那普利（C对）、福辛普利（E对）。赖诺普利（B错）与卡托普利（D错）本身含关键药效团，可直接在体内发挥药效作用。